牙龈脓肿的特点
A. 表现为急性化脓性炎症
B. 表现为慢性化脓性炎症
C. 牙齿松动
D. 牙周袋溢脓
E. 叩痛明显

正确答案：A。表现为急性化脓性炎症

解析：本题考查牙龈脓肿的特点。牙龈脓肿仅局限于龈乳头及龈缘，呈局限性肿胀，一般有异物刺入牙龈等明显的刺激因素，临床上常表现为急性化脓性炎症（A对B错）。牙齿松动（C错）、牙周袋溢脓（D错）为牙周脓肿的特点。叩痛明显（E错）为牙槽脓肿的特点。